6月龄男婴，近1个月烦躁、多汗、夜惊不安。查体：头发稀疏，心肺检查未见异常不能独坐。就诊过程中突然发生两眼上窜、面色青紫、四肢抽动。紧急处理首选
A. 维生素330万IU肌注
B. 10%葡萄糖酸钙10ml稀释1倍静脉缓慢推注
C. 苯巴比妥钠40mg肌注
D. 10%葡萄糖液15ml静脉注射
E. 20%甘露醇20ml静脉注射

正确答案：C。苯巴比妥钠40mg肌注

解析：6月龄患儿，近日烦躁多汗夜惊不安，头发稀疏，突然发生两眼上窜面色青紫四肢抽动，应诊断为维生素D缺乏性手足搐搦症。此患儿就诊过程中突然发生两眼上窜面色青紫四肢抽动，紧急处理首选的措施是苯巴比妥钠40mg肌注，从而有效的控制四肢抽动（C对）。维生素D₃30万IU肌注是急诊情况控制后采取的后续措施（A错）。10％葡萄糖酸钙10ml稀释l倍静脉缓慢推注是四肢抽动的症状控制后的下一步处理方法（B错）。葡萄糖的注射能提高患者体内的能量，不是维生素D缺乏性手足搐搦症的紧急治疗方法（D错）。甘露醇一般用于水肿的治疗（E错）。